下述哪个结构与右侧小圆肌活动有关
A. 左侧中央前回下1/3部
B. 左侧内囊膝部
C. 左侧皮质脊髓侧束
D. 右侧臂丛
E. 右侧桡神经

正确答案：D。右侧臂丛

解析：臂丛的分支之一腋神经发出纤维支配小圆肌。所以右侧臂丛（D对）发出分支支配右侧小圆肌。